若偏态分布资料一端或两端无确切的数值，描述其集中趋势指标是
A. 标准差
B. 四分位数间距
C. 算术均数
D. 几何均数
E. 中位数

正确答案：E。中位数

解析：若偏态分布资料一端或两端无确切的数值，描述其集中趋势指标是中位数（E对）。医学研究中有一类比较特殊的资料，如抗体滴度、细菌计数、血清凝集效价、某些物质浓度等，其数据特点是观察值间按倍数关系变化，对此可以计算几何均数以描述其平均水平（D错）。算数均数（C错）简称为均数，用于说明一组观察值的平均水平或集中趋势，是描述定量数据的一种最常用的方法。方差是用取平方后的单位来表示的，如果血压的原始数据用毫米汞柱表示，则方差就是毫米汞柱的平方。在统计分析中为了方便，通常将方差取平方根，还原成与原始数据观察值单位相同的变异量度（A错）。极差不稳定主要受观察值中两端极值数值的影响，如果将两端的数据去掉一定的比例，所得到的结果就会比较稳定。一种方法是把所有的观察值排序后，分成四个数目相等的段落，每个段落的观察值数目各占总例数的25%，去掉两端的25%，取中间50%观察值的数据范围即为四分位数间距（B错）。